关于炭疽芽胞杆菌叙述错误的是
A. 竹节状排列革兰阳性大杆菌
B. 无氧条件下易形成芽胞
C. 荚膜和外毒素是重要毒力因素
D. 无鞭毛，无动力
E. 有毒株产生荚膜

正确答案：B。无氧条件下易形成芽胞